男性38岁，建筑工人，近日献血时发现抗-HIV阳性，CD4T淋巴细胞0.6×10⁹/L，总淋巴细胞数2.1×10⁹/L，患者无任何症状，5年前曾赴非洲工作1年，此患者为HIV感染的哪一期
A. 0期
B. Ⅰ期
C. Ⅱ期
D. Ⅲ期
E. Ⅳ期

正确答案：C。Ⅱ期